25岁，已婚妇女，婚后2年不孕，月经尚规律，停经45天后，阴道出血1个月，量少，无腹痛，妇检：宫颈充血，较软，子宫稍大，亦较软，附件（-），宫颈粘液涂片为羊齿状结晶，尿妊娠试验（-）上述病例该患下步的诊疗措施应为
A. 黄体酮20mg/d×5肌注
B. 避孕药口服
C. 子宫切除
D. 诊刮
E. 大量雌激素止血

正确答案：D。诊刮

解析：本例很可能诊断为功血，诊刮的目的是止血和明确子宫内膜病理诊断。掌握“功能失调性子宫出血”知识点。